患者，男，67岁，患2型糖尿病，使用阿卡波糖和利拉鲁肽，目前空腹血糖6.0mmol/L左右，餐后2小时血糖7.5～8.0mmol/L。患者用药期间发生几率相对较大的不良反应有
A. 恶心、呕吐
B. 脱发
C. 骨折
D. 腹胀
E. 水肿

正确答案：A、D。恶心、呕吐；腹胀

解析：本题考查药物不良反应。患者用药期间发生几率相对较大的不良反应有恶心、呕吐（A对）、腹胀（D对）。阿卡波糖主要不良反应为：腹胀、肠鸣音亢进、腹泻；利拉鲁肽主要不良反应为：恶心、呕吐。